在药物与受体结合过程中，结合力最强的非共价键键合形式是
A. 氢键
B. 离子-偶极相互作用
C. 疏水性相互作用
D. 范德华力
E. 离子键

正确答案：E。离子键

解析：本题考查非共价键的键合。在药物与受体结合过程中，结合力最强的非共价键键合形式是离子键（E对）。非共价键的键合是可逆的结合形式，包括：范德华力、氢键、疏水键、静电引力、电荷转移复合物、偶极相互作用力等。离子键是通过两个或多个原子或化学集团失去或获得电子而成为离子后形成的，是所有非共价键键合中键能最强的一种，离子键键能400～4000kJ/mol。氢键（A错）是有机化学中最常见的一种非共价作用形式，也是药物和生物大分子作用的最基本化学键合形式，氢键键能10～40kJ/mol。在药物和受体分子中，当碳原子与其它电负性较大的原子，如N、O、S、卤素等成键时，由于电负性较大原子的诱导作用使电荷分布不均匀，导致电子的不对称分布，产生电偶极。药物分子的偶极受到来自生物大分子的离子或其它电偶极基团的相互吸引，而产生相互作用，这种相互作用对稳定药物受体复合物起到重要作用，但是这种离子-偶极（B错），偶极-偶极的作用比离子产生的静电作用要弱的多。疏水性相互作用（C错）：当药物结构中非极性链部分和生物大分子中非极性链部分相互作用时，由于相互之间亲脂能力比较相近，结合比较紧密导致两者周围围绕的能量较高的水分子层破坏，形成无序状态的水分子结构，导致体系的能量降低。范德华力（D错）是一个原子的原子核对另一个原子的外层电子的吸引作用，其键能很弱，键能0.05～40kJ/mol，是所有键合作用中最弱的一种，但非常普遍。